一男性患者40岁，6小时前发生十二指肠壶腹（球部）溃疡前壁穿孔，以下症状及体征中，不应出现的是
A. 全腹压痛及肌紧张
B. 肠鸣音亢进
C. 肝浊音界消失
D. 呼吸浅快，腹肌呈板样
E. 发热及白细胞计数上升

正确答案：B。肠鸣音亢进

解析：青年男性患者，十二指肠球部溃疡穿孔，胃液进入腹腔可对腹膜产生强烈的刺激作用，引起局部腹痛，之后迅速蔓延至全腹，出现全腹压痛、反跳痛和腹肌紧张（严重者腹肌紧张呈板样），即弥漫性腹膜炎（A对）。弥漫性的腹膜炎症刺激肠管，可使肠蠕动减弱，听诊肠鸣音减弱或消失（B错，为本题正确答案）。十二指肠穿孔后气体进入腹腔，气体覆盖于肝脏表面，可使肝浊音界消失（C对）。腹部疼痛可使腹式呼吸减弱或消失，胸式呼吸增强，由于胸廓活动度较小，故表现为浅快呼吸（D对）。穿孔后继发感染可出现发热、白细胞和中性粒细胞升高等中毒症状（E对）。